男，40岁，诊断左肾结核，膀胱容量20ml，右肾严重积水伴尿毒症，宜首先行
A. 膀胱扩大术
B. 右肾造瘘术
C. 左肾切除术
D. 左肾结核病灶清除术
E. 膀胱造瘘术

正确答案：B。右肾造瘘术

解析：青年男性患者，左肾结核，膀胱容量20ml（＜50ml，提示有膀胱挛缩），说明肾脏破坏严重已累及膀胱，故考虑行左肾切除。对侧肾严重积水并伴尿毒症，说明右侧肾功能代偿不良，故此时宜首先作右肾造瘘术（B对）引流肾积水，保护右肾功能，待肾功能好转后再切除无功能的左侧患肾。膀胱扩大术（A错）主要用于肾结核并发挛缩膀胱的治疗，需待患肾切除和抗结核治疗、膀胱结核完全痊愈后才可进行。左肾切除术（C错）需待对侧肾积水缓解、肾功能恢复后进行。左肾结核病灶清除术（D错）适用于肾实质表面闭合性的、与集合系统不相通的局灶性结核脓肿。膀胱造瘘术（E错）不宜用于已有膀胱挛缩的患者。